女，55岁。左眼睑下垂，复视5个月。查体见左眼球外展位，最可能的诊断是
A. 左侧后交通动脉瘤
B. 基底动脉瘤
C. 椎动脉瘤
D. 左侧前交通动脉瘤
E. 大脑中动脉瘤

正确答案：A。左侧后交通动脉瘤

解析：患者老年女性，左眼睑下垂，复视5个月，查体见左眼球外展位提示左侧动眼神经麻痹。因此，考虑诊断为左侧后交通动脉瘤（A对）。基底动脉瘤（B错）、椎动脉瘤（C错）可出现枕部和面部疼痛、面肌痉挛、面瘫及脑干受压等症状（P195）。左侧前交通动脉瘤（D错）会出现精神症状、单侧或双侧下肢瘫痪和意识障碍等症状（P195）。大脑中动脉瘤（E错）会出现偏瘫、失语和抽搐等症状（P195）。